胶原纤维排列与牙本质小管平行，且与表面垂直，靠近冠部最先形成的牙本质是
A. 管周牙本质
B. 罩牙本质
C. 球间牙本质
D. 修复性牙本质
E. 骨样牙本质

正确答案：B。罩牙本质

解析：罩牙本质是靠近冠部最先形成的牙本质，其中的胶原纤维的排列与牙本质小管平行。且与牙面垂直，矿化均匀。掌握“牙本质”知识点。